目前最常用的评价肾小球滤过率的指标是
A. eGFR
B. 菊粉清除率
C. 内生肌酐清除率
D. 血肌酐
E. 血尿素

正确答案：C。内生肌酐清除率

解析：菊粉被肾小球自由滤过，并在肾小管和集合管不被重吸收和分泌，应用菊粉测定肾小球滤过率虽准确可靠，但操作不便（B错）。内生肌酐清除率（C对）在数值上较接近肾小球滤过率，故临床上常用它来推测肾小球滤过率。血肌酐（D错）可受蛋白摄入情况及肠道吸收功能影响，不能准确评价肾小球滤过率。血尿素（E错）全部由肾小球滤过，30%～40%被肾小管重吸收，肾小管亦分泌少量尿素，不用于评价肾小球滤过率。